急性失血时，最先出现的调节反应是
A. 血管的自身调节
B. 交感神经兴奋
C. 迷走神经兴奋
D. 血中血管升压素增多
E. 血中血管紧张素Ⅱ增多

正确答案：B。交感神经兴奋